要求气密性良好的医疗器械是
A. 水银血压计
B. 血糖分析仪
C. 电子体温计
D. 一次性注射器
E. 一次性输液器

正确答案：A。水银血压计

解析：本题考查的是医疗器械。要求气密性良好的医疗器械是水银血压计（A对）。血糖分析仪（B错）是使用者通过使用指尖毛细血管的血液来进行血糖浓度自测的一种仪器。电子体温计（C错）由温度传感器，液晶显示器，纽扣电池，专用集成电路及其他电子元器件组成。一次性针筒就是一次性注射器（D错），是采用高分子聚丙烯材料制成的，分三件式和两件式，三件式结构为芯杆、胶塞、外套三件及注射针、外包装组成，两件式结构是芯杆，外套及注射针、外包装组成。一次性输液器（E错）是一种常见的医疗耗材，经过无菌处理，建立静脉与药液之间通道，用于静脉输液。一般由静脉针或注射针、针头护帽、输液软管、药液过滤器、流速调节器、滴壶、瓶塞穿刺器、空气过滤器等八个部分连接组成，部分输液器还有注射件，加药口等。